6MP的结构类似物是
A. I
B. X
C. A
D. T
E. U

正确答案：A。I